主要用于治疗皮肤真菌感染，可抑制角鲨烯环氧酶活性，属于丙烯胺类的抗真菌药物是
A. 制霉菌素
B. 特比萘芬
C. 联苯苄唑
D. 阿莫罗芬
E. 环吡酮胺

正确答案：B。特比萘芬

解析：本题考查特比萘芬。主要用于治疗皮肤真菌感染，可抑制角鲨烯环氧酶活性，属于丙烯胺类的抗真菌药物是特比萘芬（B对）。制霉菌素（A错）为多烯类抗生素类抗真菌药，用于治疗皮肤、黏膜念珠菌病。口服治疗肠道或食管念珠菌病，局部用药治疗口腔念珠菌病、阴道念珠菌病和皮肤念珠菌病。联苯苄唑（C错）为唑类抗真菌药，通过抑制真菌细胞色素酶而抑制真菌细胞膜重要成分麦角固醇的合成，使细胞膜屏障作用障碍而发挥抗真菌作用。阿莫罗芬（D错）为吗啉类抗真菌药，通过干扰真菌细胞膜麦角固醇的合成导致真菌死亡。对皮肤癣菌、念珠菌、皮炎芽生菌、荚膜组织胞浆菌、申克孢子丝菌有抗菌活性。环吡酮胺（E错）为吡啶酮类抗真菌药，作用于真菌细胞膜，体外抑菌实验显示对皮肤癣菌、酵母菌、放线菌及其他真菌感染有较强的抑制作用。